不属于口腔癌“无瘤”手术要求的是
A. 保证手术在正常组织内进行
B. 避免切破肿瘤，勿挤压瘤体
C. 不宜整块挖出，暴露的肿瘤面覆以纱布、缝包
D. 创口缝合前大量盐水冲洗，化疗药物湿敷
E. 创口缝合时更换手套及器械

正确答案：C。不宜整块挖出，暴露的肿瘤面覆以纱布、缝包

解析：本题考查口腔癌“无瘤”手术的要求。不属于口腔癌“无瘤”手术要求的是不宜整块挖出，暴露的肿瘤面覆以纱布、缝包（C错，为本题的正确答案）。口腔颌面部恶性肿瘤手术失败的主要原因是局部复发或远处转移，因此，在手术中应严格遵守无瘤操作：保证手术在正常组织内进行（A对）；避免切破肿瘤，勿挤压瘤体（B对）；行整体切除不宜分块挖出；创口缝合前大量盐水冲洗，化疗药物湿敷（D对）；创口缝合时更换手套及器械（E对）。